奇经八脉中既称“血海”又称“经脉之海”者是：
A. 冲脉
B. 任脉
C. 督脉
D. 带脉
E. 维脉

正确答案：A。冲脉

解析：本题考查奇经八脉的功能，属于理解记忆内容。冲脉既称“血海”又称“经脉之海”（A对）。任脉有“阴脉之海”之称（B错）。督脉有“阳脉之海”之称（C错）。